血管加压素的主要生理作用是
A. 作用于远端肾小管，促进水的重吸收
B. 作用于近端肾小管，促进水的重吸收
C. 作用于远端肾小管，促进钠的重吸收
D. 作用于远端肾小管，促进水的排出
E. 作用于近端肾小管，促进水的排出

正确答案：A。作用于远端肾小管，促进水的重吸收

解析：血管加压素（A对）也称抗利尿激素，其V₂受体分布于肾的集合管和远曲小管的内皮细胞上，通过结合V₂受体，可增强水的重吸收，起到抗利尿的作用。